病毒性心肌炎气阴亏虚证治疗首选方是
A. 桂枝甘草龙骨牡蛎汤
B. 炙甘草汤合生脉散
C. 黄芪桂枝五物汤
D. 炙甘草汤
E. 参附汤

正确答案：B。炙甘草汤合生脉散

解析：病毒性心肌炎气阴两虚…治疗首选方是炙甘草汤合生脉散。气阴两虚证由热毒犯心，病久耗气伤阴，气阴亏虚所致。临床以心悸气短，五心烦热，舌红少苔或花剥苔为特征。治疗应益气养阴，宁心复脉。选方炙甘草汤合生脉散加减（B对）。桂枝甘草龙骨牡蛎汤主治心阳不足证，烦躁不安，心悸，或失眠，心胸憋闷，畏寒肢冷，气短自汗，面色苍白（A错）。黄芪桂枝五物汤主治血痹，肌肤麻木不仁，脉微涩而紧（C错）。炙甘草汤主治阴血阳气虚弱，心脉失养证（D错）。参附汤主治元气大亏，阳气暴脱，汗出粘冷，四肢不温，呼吸微弱，或上气喘急，或大便自利，或脐腹疼痛，面色苍白，脉微欲绝（E错）。